社会医学的性质是
A. 自然科学
B. 社会科学
C. 交叉学科
D. 基础学科

正确答案：C。交叉学科

解析：本题考查社会医学的性质。社会医学是从社会的角度研究医学和健康问题的一门交叉学科（C对ABD错），它研究社会因素与个体及群体健康和疾病之间相互作用及其规律，制定相应的社会策略和措施，保护和增进个体及人群的身心健康和社会活动能力，提高生命质量，充分发挥健康的社会功能，提高人群的健康水平。